关于真核生物mRNA成熟过程的的描述，错误的是
A. mRNA前体可以发生RNA编辑
B. mRNA前体需在5'端加帽
C. mRNA前体逐渐形成三叶草的结构
D. mRNA前体需在3'端加多聚A尾
E. mRNA前体需剪切内含子

正确答案：C。mRNA前体逐渐形成三叶草的结构

解析：真核前体mRNA经首、尾修饰、剪接和编辑加工后才能成熟，包括：前体mRNA在5'-端加入“帽”结构（B对）；在3'-端特异位点断裂并加上多聚腺苷酸尾（D对）；剪接去除内含子（E对）；对基因的编码序列进行转录后加工（A对）。tRNA前体逐渐形成三叶草结构（C错，为本题正确答案）（P46）。前体mRNA也称为初级mRNA转录物或核不均一RNA（hnRNA）